帽状期的成釉器由几层细胞构成
A. 2
B. 3
C. 4
D. 5
E. 以上都不对

正确答案：B。3

解析：帽状期：蕾状期成釉器中的细胞继续增生，成釉器增大，基底部向内凹陷，形状如帽子，故称帽状期成釉器。此期成釉器的细胞分化为三层：外釉上皮层、内釉上皮层、星网状层。掌握“牙胚的发生及分化”知识点。